诊断恶性肿瘤的主要依据是
A. 肿瘤的肉眼形态
B. 肿瘤对机体的影响
C. 肿瘤的大小
D. 肿瘤细胞的异型性
E. 肿瘤的继发改变

正确答案：D。肿瘤细胞的异型性

解析：肿瘤细胞的异型性（D对）是指肿瘤组织结构和细胞形态与相应的正常组织有不同程度的差异，是判定良性与恶性肿瘤最具诊断意义的指标，良性肿瘤的异型性小，恶性肿瘤的异型性大。肿瘤的肉眼形态（A错）、对机体的影响（B错）、大小（C错）和继发改变（E错）也是良性肿瘤与恶性肿瘤的区别点，但都不是最主要的依据。